太溪在五输穴中，属
A. 井穴
B. 荥穴
C. 合穴
D. 经穴
E. 输穴

正确答案：E。输穴

解析：该题考查五输穴。太溪为足少阴肾经的腧穴，足少阴肾经的五输穴井荥输经合穴分别为涌泉、然谷、太溪、复溜、阴谷（E对ABCD错）。